麝香芳香辛温，是临床常用的开窍药，其主治病证不包括
A. 健忘恍惚
B. 热病神昏
C. 气郁暴厥
D. 咽喉肿痛
E. 跌打损伤

正确答案：A。健忘恍惚

解析：本题考查的是麝香的主治病证。麝香的主治病证不包括健忘恍惚（A错，为本题正确答案）。麝香：【主治病证】（1）热病神昏（B对），中风痰厥，气郁暴厥（C对），中恶神昏。（2）闭经，癥瘕，难产死胎。（3）胸痹心痛，心腹暴痛，痹痛麻木，跌打损伤（E对）。（4）疮肿，瘰疬，咽喉肿痛（D对）。健忘恍惚为石菖蒲的主治病证。石菖蒲：【主治病证】（1）痰湿蒙蔽心窍之神昏，癫痫，耳聋，耳鸣。（2）心气不足之心悸失眠、健忘恍惚。（3）湿浊中阻之脘腹痞胀，噤口痢。